易引起便秘的药物是
A. 多沙唑嗪
B. 赖诺普利
C. 羟考酮
D. 辛伐他汀
E. 氨氯地平

正确答案：C。羟考酮

解析：本题考查药物的不良反应。易引起便秘的药物是羟考酮（C对）。羟考酮为半合成阿片类药物，可引起便秘、恶心、呕吐、头晕等不良反应。多沙唑嗪（A错）为α肾上腺素能受体阻断剂，主要的不良反应为直立性低血压（伴高血压的老年患者易出现）、眩晕、头痛、乏力、困倦、逆向射精等。赖诺普利（B错）为血管紧张素转换酶抑制剂，用于高血压的治疗。常见不良反应有：轻微且短暂的头痛、眩晕、疲乏、嗜睡、恶心、咳嗽。辛伐他汀（D错）属于他汀类的调血脂药，典型的不良反应是横纹肌溶解症。氨氯地平（E错）为二氢吡啶类钙通道受体阻滞剂，常见的不良反应为足踝部水肿。